女性，45岁。双手和膝关节肿痛伴晨僵1年。体检：肘部可及皮下结节，质硬，无触痛。最有助于确定诊断的是
A. 关节影像检查
B. 滑液检查
C. 抗核抗体
D. ESR
E. CRP

正确答案：A。关节影像检查

解析：中年女性患者（类风湿关节炎好发人群），出现双手和膝关节肿痛伴晨僵1年病史（类风湿关节炎关节常见表现），并在肘部可及质硬、无触痛皮下结节（类风湿结节），患者诊断首先考虑为类风湿关节炎。关节影像学改变（A对）为类风湿关节炎诊断的重要辅助条件，X片检查可有助于关节病变分期，MRI可显示关节软组织早期病变。关节滑液检查（B错）为有创性检查，可引起关节内感染等并发症。抗核抗体（C错）阳性主要见于系统性红斑狼疮。ESR（D错）与CRP增高（E错）为一般炎症指标，无特异性。